女，30岁。已婚。平时月经规律。停经40天，右下腹剧痛4小时伴头晕及肛门坠胀感。查体：BP80/56mmHg，面色苍白，痛苦貌。下腹部压痛及反跳痛（+），尤以右侧为著，肌紧张不明显，移动性浊音（+）。妇科检查：宫颈举痛，宫体稍大，右附件区触及不规则包块，大小约4cm×3cm×3cm，压痛（+）。血红蛋白100g/L。该患者最可能的诊断是
A. 卵巢滤泡囊肿破裂
B. 卵巢黄体囊肿破裂
C. 卵巢囊肿蒂扭转
D. 输卵管妊娠破裂
E. 卵巢子宫内膜异位囊肿破裂

正确答案：D。输卵管妊娠破裂

解析：中年已婚妇女，停经40天，右下腹剧痛4小时（典型症状为停经后腹痛与阴道流血）伴头晕及肛门坠胀感（血液积聚于直肠子宫陷凹时，可出现肛门坠胀感），查体见BP80／56mmHg，面色苍白（当腹腔出血较多时，可出现面色苍白、脉搏快而细弱、心率增快和血压下降等休克表现），下腹部压痛及反跳痛（+），尤以右侧为著，肌紧张不明显（腹部检查：下腹有明显压痛及反跳痛，尤以患侧为著，但腹肌紧张轻微），移动性浊音（+）（出血较多时腹部叩诊有移动性浊音），宫颈举痛（盆腔检查将宫颈轻轻上抬或向左右摆动时引起剧烈疼痛，称为宫颈举痛或摇摆痛，此为输卵管妊娠的主要体征之一），宫体稍大，右附件区触及不规则包块，压痛（+）（子宫一侧或其后方可触及肿块，边界多不清楚，触痛明显），最可能的诊断是输卵管妊娠破裂（D对）。卵巢囊肿蒂扭转（P55）（C错）常由体位改变诱发；卵巢子宫内膜异位囊肿破裂（P271）（E错）患者长期有下腹痛和痛经等子宫内膜异位症表现，破裂常发生于经期前后、性交后或其他负压增加的情况下；均无停经史、阴道流血及失血性休克表现。卵巢滤泡囊肿破裂（A错）、卵巢黄体囊肿破裂（P55）（B错）可有一侧附件区压痛，可有出血性休克，但均无停经史。